环境流行病学调查方法中，环境卫生学中最常用的一种调查方法是
A. 回顾性调查
B. 现况调查
C. 前瞻性调查
D. 实验性研究
E. 理论性研究

正确答案：B。现况调查

解析：本题考查环境流行病学调查方法。环境流行病学研究方法通常采用描述性（包括生态和现况）研究、分析性（病例-对照、定群）研究、实验流行病学的研究方法。现况调查（B对ACDE错）是环境流行病学调查方法中最常用的一种方法，是指在特定时间点调查环境因素和健康状况，在没有实验或干预的情况下，反映这些环境因素和健康状况之间的关系。